某女，33岁。1年前顺产一女婴，哺乳至今，准备断奶近日因工作不顺，又导致肝胃不和、消化不良。治当回乳、消食、疏肝，宜选用的药是
A. 稻芽
B. 麦芽
C. 山楂
D. 神曲
E. 鸡内金

正确答案：B。麦芽

解析：本题考查的是麦芽的功效。1年前顺产一女婴，哺乳至今，准备断奶近日因工作不顺，又导致肝胃不和、消化不良。治当回乳、消食、疏肝，宜选用的药是麦芽（B对）。麦芽：【功效】消食和中，回乳，疏肝。稻芽（A错）：【功效】消食和中，健脾开胃。山楂（C错）：【功效】消食化积，活血散瘀。神曲（D错）：【功效】消食和胃。鸡内金（E错）：【功效】运脾消食，固精止遗，化坚消石。